社区诊断的内容不包括
A. 社区卫生资源分析
B. 社区保健意识
C. 社区卫生保健资金投入情况
D. 社区卫生状况调查
E. 社区人群健康状况评价

正确答案：C。社区卫生保健资金投入情况

解析：本题考查社区诊断的内容。社区诊断的内容包括：①社区卫生资源分析（A对）；②社区保健意识（B对）；③社区卫生状况调查（D对）；④社区人群健康状况评价（E对）。社区卫生保健资金投入情况（C错，为本题正确答案）不属于社区诊断的内容。